某女，58岁。素患胆囊结石，症见口苦、口黏、右胁下胀痛。5日前又患咳嗽，咯吐黄痰、咽痛，兼见尿黄、便秘，舌红、苔黄腻。宜选用的药是
A. 郁金
B. 虎杖
C. 血竭
D. 干漆
E. 北刘寄奴

正确答案：B。虎杖

解析：本题考查的是虎杖的主治病证。某女，58岁。素患胆囊结石，症见口苦、口黏、右胁下胀痛。5日前又患咳嗽，咯吐黄痰、咽痛，兼见尿黄、便秘，舌红、苔黄腻。宜选用的药是虎杖（B对）。虎杖：【主治病证】（1）湿热黄疸，淋浊，带下。（2）水火烫伤，疮痈肿毒，毒蛇咬伤。（3）闭经，痛经，癥瘕，跌打损伤，风湿痹痛。（4）肺热咳嗽。（5）热结便秘。（6）肝胆及泌尿系结石症。郁金（A错）：【主治病证】（1）胸腹胁肋胀痛或刺痛，月经不调，痛经，癥瘕痞块。（2）热病神昏，癫痫发狂。（3）血热之吐血、衄血、尿血，妇女倒经。（4）湿热黄疸，肝胆或泌尿系结石症。血竭（C错）：【主治病证】（1）瘀血闭经、痛经，产后瘀阻腹痛。（2）癥瘕痞块，胸腹刺痛。（3）跌打损伤，瘀血肿痛。（4）外伤出血，溃疡不敛。干漆（D错）：【主治病证】（1）闭经，癥瘕积聚。（2）虫积腹痛。北刘寄奴（E错）：【主治病证】（1）跌打损伤，瘀血闭经，月经不调，产后瘀血腹痛，癥瘕积聚。（2）外伤出血，血痢，血淋。（3）湿热黄疸，水肿，白带过多。